按十二经脉的流注次序，肝经向下流注的经脉是
A. 膀胱经
B. 胆经
C. 三焦经
D. 心经
E. 肺经

正确答案：E。肺经

解析：十二经脉的循行走向依次为手太阴肺经→手阳明大肠经→足阳明胃经→足太阴脾经→手少阴心经（D错）→手太阳小肠经→足太阳膀胱经（A错）→足少阴肾经→手厥阴心包经→手少阳三焦经（C错）→足少阳胆经（B错）→足厥阴肝经→手太阴肺经（E对）。